中药传统养护技术对抗贮存法是采用两种或两种以上药物同贮，相互克制，起到防止虫蛀、霉变作用的养护方法。采用对抗贮存法养护蛤蚧时，可同贮的中药饮片是
A. 牡丹皮
B. 大蒜
C. 细辛
D. 花椒
E. 冰片

正确答案：D。花椒

解析：本题考查的是对抗贮存法。中药传统养护技术对抗贮存法是采用两种或两种以上药物同贮，相互克制，起到防止虫蛀、霉变作用的养护方法。采用对抗贮存法养护蛤蚧时，可同贮的中药饮片是花椒（D对）。对抗贮存法也称异性对抗驱虫养护，是采用两种或两种以上药物同贮，相互克制，起到防止虫蛀、霉变作用的养护方法。一般适用于数量不多的药物，如牡丹皮（A错）与泽泻、山药同贮，蛤蚧与花椒、吴茱萸或荜澄茄同贮，蕲蛇或白花蛇与花椒或大蒜瓣同贮，土鳖虫与大蒜（B错）同贮，人参与细辛（C错）同贮，冰片（E错）与灯心草同贮，硼砂与绿豆同贮，藏红花与冬虫夏草同贮等。